狗脊应
A. 麸炒
B. 砂炒
C. 米炒
D. 蛤粉炒
E. 滑石粉炒

正确答案：B。砂炒

解析：本题考查的是狗脊的炮制方法。狗脊应砂炒（B对）。砂炒，亦称砂烫法，是将净选或切制后的药物与热砂共同拌炒的方法。砂炒的目的：①增强疗效，便于调剂和制剂，如狗脊、穿山甲等。②降低毒性，如马钱子等。③便于去毛，如骨碎补等。④矫臭矫味，如鸡内金、脐带等。麸炒（A错）是将净制或切制后的药物用麦麸熏炒的方法。麸炒的目的：①增强疗效，如山药、白术、芡实等。②缓和药性，如苍术、枳实、薏苡仁等。③矫臭矫味，如僵蚕等。米炒（C错）是将净制或切制后的药物与米同炒的方法。米炒的目的：①增强药物的健脾止泻作用，如党参。②降低药物的毒性，如红娘子、斑蝥。③矫正不良气味，如昆虫类药物。蛤粉炒（D错），又称蛤粉烫，是将净制或切制后的药物与蛤粉共同拌炒的方法。蛤粉炒的目的：①使药物质地酥脆，便于制剂和调剂。②降低药物的滋腻之性，矫正不良气味。如阿胶、鹿角胶等。滑石粉炒（E错），又称滑石粉烫，是将净制或切制后的药物与滑石粉共同拌炒的方法。滑石粉炒的目的：①使药物质地酥脆，便于粉碎和煎煮，如黄狗肾等。②降低毒性及矫正不良气味，如刺猬皮、水蛭等。